以吐温80作增溶剂的清热口服液，最宜选用的防腐剂是
A. 苯甲酸钠
B. 尼泊金乙酯
C. 山梨酸钾
D. 苯酚
E. 苯甲醇

正确答案：C。山梨酸钾